儿童期热能消耗是
A. 生长发育消耗的热能
B. 维持基础代谢消耗的热能
C. 食物特殊动力作用
D. 体力活动消耗的热能
E. 以上均是

正确答案：E。以上均是